某女，25岁。胃痛吐酸，喜温恶寒，舌淡，苔薄白，脉弦紧，医生诊断后开具处方：高良姜、香附、延胡索、吴茱萸、木香，以温中散寒，和胃止痛。该患者适宜的服药时间是
A. 饭前
B. 饭后
C. 睡前
D. 空腹
E. 频服

正确答案：B。饭后

解析：本题考查的是饮片处方的服用时间。胃痛吐酸，喜温恶寒，舌淡，苔薄白，脉弦紧，医生诊断后开具处方：高良姜、香附、延胡索、吴茱萸、木香，以温中散寒，和胃止痛。该患者适宜的服药时间是饭后（B对）。药品治疗疾病有不同的特点，根据病情和药效，服药时间有饭前、饭后和早晚的区别。一般药物宜于饭后服，滋补药宜饭前服（A错），驱虫和泻下药宜空腹服（D错），安眠药宜睡前服（C错），抗疟药宜在发作前1～2小时服用，健胃药和对胃肠刺激性较大的药物宜饭后服。无论饭前或饭后服药，均应略有间隔，以免影响疗效。重病者不拘时间，迅速服用，有的也可煎汤代茶饮。昏迷的病人吞咽困难可用鼻饲法。总之，应根据病情需要和药物性能确定不同的服药时间，以便取得好的治疗效果。频服（E错）是指少量多次，频频服用的方法。止吐药宜小量多次频服。